属于褪黑素受体激动剂的催眠药物是
A. 扎来普隆
B. 艾司唑仑
C. 地西泮
D. 苯巴比妥
E. 雷美替胺

正确答案：E。雷美替胺

解析：本题考查镇静催眠药的分类。属于褪黑素受体激动剂的催眠药物是雷美替胺（E对）；扎来普隆（A错）属于非苯二氮䓬类药物；艾司唑仑（B错）和地西泮（C错）属于苯二氮䓬类药物；苯巴比妥（D错）属于巴比妥类药物。